微小胃癌指的是癌灶直径在
A. 5mm以下
B. 10mm以下
C. 15mm以下
D. 20mm以下
E. 25mm以下

正确答案：A。5mm以下